牙龈切除术前测袋定点的目的
A. 确定切口方向
B. 了解牙周袋深度
C. 了解牙龈厚度
D. 确定切口位置
E. 以上都是

正确答案：E。以上都是

解析：本题考查牙龈切除术前测袋定点的目的。牙龈切除术前，使用印记镊法或探针法定点，通过连续的定点，可以确定切口位置（D对）即从定点的根方1～2mm处作切口，确定切口方向（A对）即与牙面成45°角外斜，用印记镊法或探针探查牙周袋内侧时，可了解牙周袋深度（B对），刺入牙龈标记时，也可了解牙龈厚度（C对）。（ABCD均对，故E为本题的正确答案）。